患者，女，28岁，妊娠24周，查空腹血糖8.2mmol/L，餐后血糖13.2mmol/L，糖化血红蛋白7.3%。首选的降糖药物是
A. 利拉鲁肽
B. 达格列净
C. 胰岛素
D. 格列美脲
E. 二甲双胍

正确答案：C。胰岛素

解析：本题考查妊娠期糖尿病的药物治疗。胰岛素（C对）妊娠毒性较低，对于妊娠期妇女较其他降糖药物更为安全，可以作为妊娠期糖尿病首选。